具有医院药学工作特色的职业道德要求是
A. 忠诚事业、献身药学
B. 精心调剂、耐心解释
C. 依法促销、诚信推广
D. 规范包装、如实宣传
E. 保护环境、造福人类

正确答案：B。精心调剂、耐心解释